患儿，男，10岁。皮肤黄染伴右上腹绞痛2天。实验室检查：尿胆红素（+），尿胆原（-）。应首先考虑的是
A. 蚕豆病
B. 胃炎
C. 胆道蛔虫症
D. 急性病毒性肝炎
E. 遗传性球形红细胞增多症

正确答案：C。胆道蛔虫症

解析：胆道蛔虫症（C对）为最常见的异位蛔虫症。蛔虫钻入十二指肠壁的壶腹孔导致Oddi括约肌与胆总管痉挛，引起突发性右上腹钻顶样疼痛，可放射至背部，可出现发热、白细胞计数增高，还可出现黄疸，进而尿胆红素阳性；蚕豆病（A错）表现巩膜仅轻度黄染，且没有右上腹疼痛；胃炎（B错）没有黄疸症状，疼痛为左上腹，且尿胆红素不会升高；急性病毒性肝炎（D错）尿胆红素和尿胆原均阳性；遗传性球形红细胞增多症（E错）尿胆原是增高的。